药物利用指数研究中，某药品的日处方剂量基本合理，表明
A. DUI接近1
B. DUI＜0.8
C. DUI＞1.2
D. B/A＜1
E. B/A≥1

正确答案：A。DUI接近1

解析：本题考查日处方剂量。DUI﹥1.0，说明医师处方日处方剂量大于DDD，即超过了推荐的限定日剂量；DUI≤1.0，说明医师的处方剂量小于DDD，可能剂量不足；DUI接近于1.0（A对），则认为剂量使用基本合理。